性能粘结力强，不溶于水，封闭性好的粘结材料
A. 磷酸锌粘固剂
B. 树脂类粘固剂
C. 聚羧酸粘固剂
D. 玻璃离子粘固剂
E. 氧化锌丁香油粘固剂

正确答案：B。树脂类粘固剂

解析：树脂类粘固剂：其粘结力强，不溶于水，封闭性好，但应注意冠边缘残余粘接剂刺激龈组织的问题。掌握“修复体试戴、磨光与粘固”知识点。